急性化学中毒的现场处理错误的是
A. 尽早使用排毒剂
B. 口服毒物应迅速催吐
C. 作好诊断及鉴别诊断
D. 保留部分污染衣物
E. 吸入中毒者要保持呼吸道通畅

正确答案：D。保留部分污染衣物

解析：急性化学中毒的现场处理要点：①脱离中毒环境；②彻底清除和清洗污染衣物及眼、皮肤、毛发等；③口服毒物应迅速催吐、洗胃、灌肠或导泻；④吸入中毒者要保持呼吸道通畅；⑤心跳呼吸骤停时，应立即实施心肺复苏术；⑥作好诊断及鉴别诊断，防止误诊、误治；⑦尽早使用解毒、排毒剂。掌握“突发公共卫生事件”知识点。